特发性肺纤维化急性期最有效的治疗是
A. 持续低流量吸氧
B. 抗感染治疗
C. 支气管扩张剂治疗
D. 支气管肺泡灌洗
E. 糖皮质激素治疗

正确答案：E。糖皮质激素治疗

解析：特发性肺纤维化急性期最有效的治疗是糖皮质激素治疗（E对）。持续低流量吸氧（A错）用于慢阻肺患者的家庭氧疗或伴有高碳酸血症的呼吸衰竭（Ⅱ型呼衰）。抗感染治疗（B错）用于合并有细菌感染的治疗。支气管扩张剂治疗（C错）用于支气管哮喘的治疗。支气管肺泡灌洗（D错）可用于确诊肺部感染，特别是免疫缺陷病人的感染、肺癌的细胞学诊断以及肺泡蛋白沉着症的诊断和治疗。